不属于备洞时易损伤牙髓因素的是
A. 施加力大
B. 用水冷却
C. 持续性钻磨
D. 髓腔解剖不熟悉
E. 持续性干磨

正确答案：B。用水冷却

解析：钻磨牙时用锋利器械间断操作，并用水冷却：不向髓腔方向加压；对牙体组织结构、髓腔解剖形态及增龄变化必须有清楚的了解，以防止意外穿髓。掌握“银汞充填术窝洞制备、干燥及充填”知识点。